安全性毒理学评价程序原则是
A. 按一定顺序进行
B. 最短的时间
C. 最经济的办法
D. 以上都是

正确答案：D。以上都是

解析：本题考查安全性毒理学评价程序原则。安全性毒理学评价程序原则是：1.按一定顺序进行；2.最短的时间；3.最经济的办法（D对ABC错）。